对由抗癫痫药所致的骨质疏松者宜选用
A. 钙制剂+维生素D+双膦酸盐
B. 维生素D
C. 钙制剂+维生素+雌激素
D. 特拉唑嗪
E. 降钙素

正确答案：B。维生素D

解析：本题考查骨质疏松症的药物治疗。对由抗癫痫药所致的骨质疏松者宜选用维生素D（B对）。钙制剂+维生素D+双膦酸盐（A错）用于治疗老年性骨质疏松症。钙制剂+维生素+雌激素（C错）用于防治女性绝经后OP。特拉唑嗪（D错）用于治疗轻度或中度前列腺增生引起的排尿困难和轻度或中度高血压。降钙素（E错）用于骨质疏松伴骨折引起的慢性疼痛。